导致臭氧层破坏而出现空洞的化合物是
A. 氯氟烃
B. 烟尘
C. CO₂
D. SO₂、颗粒物
E. SO₂、NOₓ

正确答案：A。氯氟烃

解析：本题考查导致臭氧层破坏而出现空洞的化合物。氯氟烃（A对BCDE错）是一类有机氯化物，是人类活动中产生的有害物质，它们能够穿透臭氧层，并与臭氧发生反应，从而破坏臭氧层，导致臭氧层出现空洞。